急性重型肝炎诊断的重要依据是
A. 凝血酶原活动度<40%
B. 胆红素>17.1umol/L
C. 碱性磷酸酶明显升高
D. 丙氨酸转氨酶明显升高
E. HPT逐渐升高

正确答案：A。凝血酶原活动度<40%

解析：凝血酶原时间（PT）及PTA（凝血酶原活动度）是反映肝脏凝血因子合成功能的重要指标，PTA是PT测定值的常用表示方法，对判断疾病进展及预后有较大价值，近期内PTA进行性降至40%以下（A对）为肝衰竭（重型肝炎）的重要诊断标准之一，<20%者提示预后不良。胆红素>17.1umol/L（B错）及碱性磷酸酶明显升高（C错）见于肝细胞变性坏死，胆红素代谢障碍或者肝内胆汁淤积时。丙氨酸转氨酶（ALT）（D错）为反映肝实质损害最常用的指标，1%的肝细胞发生坏死时，血清ALT水平即可升高1倍。HPT逐渐升高（E错）是急性重型肝炎预后良好的标志。